克罗恩病最典型的肠道溃疡形态是
A. 不规则深大溃疡
B. 多发浅溃疡
C. 纵行溃疡
D. 环形溃疡
E. 烧瓶样溃疡

正确答案：C。纵行溃疡

解析：克罗恩病最典型的肠道溃疡形态是纵行溃疡（C对），进而可发展为裂隙，形成鹅卵石样外观。不规则溃疡（A错）主要见于细菌性痢疾（P360），也称地图样溃疡。多发浅溃疡（B错）主要见于溃疡性结肠炎（P194）。环形溃疡（D错）主要见于肠结核（P356）。烧瓶样溃疡（E错）主要见于肠阿米巴病（P369）。